用复合树脂充填窝洞时，应选用下列哪一种消毒剂
A. 50%香草酚乙麝醇溶液
B. 樟脑酚合剂
C. 75%乙醇
D. 氯酚樟脑薄荷

正确答案：C。75%乙醇

解析：本题考查常用的消毒药物。75%乙醇消毒窝洞后酒精会挥发，不会影响树脂的聚合，因此选用复合树脂充填窝洞时可用来消毒窝洞（C对）。50%香草酚乙麝醇溶液（A错）、樟脑酚合剂（B错）、氯酚樟脑薄荷（D错）是酚类会阻碍牙色材料复合树脂的聚合，不能用作复合树脂充填窝洞时的窝洞消毒。